过期妊娠需立即终止妊娠的指征是
A. 尿雌激素/肌酐比值为16
B. B超显示羊水指数6cm
C. Ⅲ度羊水粪染
D. 无应激试验为反应型
E. 12小时胎动为15次

正确答案：C。Ⅲ度羊水粪染

解析：已确诊过期妊娠，若有下列情况之一应立即终止妊娠：（1）宫颈条件成熟。（2）胎儿≥4000g或胎儿生长受限。（3）12小时内胎动累计数＜10次（E错）或无应激试验为无反应型（D错），宫缩应激实验阳性或可疑时。（4）持续性雌激素/肌酐（E/C）比值，10～15为警戒值，＜10为危险值（A错）。（5）羊水指数≤5cm（B错）或三度羊水粪染（C对）。（6）并发中度或重度妊娠期高血压疾病。